血源性肺脓肿最常见的病原体是
A. 大肠杆菌
B. 产气杆菌
C. 金黄色葡萄球菌
D. 肺炎杆菌
E. 草绿色链球菌

正确答案：C。金黄色葡萄球菌

解析：血源性肺脓肿是因皮肤外伤感染、疖、痈、中耳炎或骨髓炎等所致的脓毒症，菌栓经血行播散到肺，引起小血管栓塞、炎症和坏死而形成的，致病菌以金黄色葡萄球菌（C对）、表皮葡萄球菌及链球菌为常见。大肠杆菌（A错）是肠道的正常菌群，是机会性致病菌，其常导致肠外感染，以泌尿系统感染为主，较少导致呼吸系统感染。产气杆菌（B错）属于厌氧菌，是吸入性肺脓肿的常见致病菌之一。肺炎杆菌（D错），又叫肺炎克雷伯杆菌，其可导致肺炎从而导致继发性肺脓肿。草绿色链球菌（E错）不是血源性肺脓肿最常见的病原体，其是亚急性心内膜炎的常见致病菌。